某病畜的卫生处理措施如下：病畜不准解体，2m深坑加石灰掩埋，肉绝对禁止食用。此病畜可能感染了哪种人畜共患传染病
A. 结核
B. 炭疽
C. 猪瘟
D. 口蹄疫
E. 布氏杆菌病

正确答案：B。炭疽